男性，20岁。3天前患感冒后发热38℃，左侧胸部刺痛。查体：左腋下，左下胸可听到胸膜摩擦音。最合适的诊断是
A. 肺炎球菌肺炎
B. 葡萄球菌肺炎
C. 癌性胸膜炎
D. 干性胸膜炎
E. 渗出性胸膜炎

正确答案：A。肺炎球菌肺炎

解析：患者男，20岁，出现感冒后的发热，左侧胸部刺痛，查体可见左腋下，左下胸可听到胸膜摩擦音，胸膜炎可出现胸膜摩擦感和摩擦音，而渗出性胸膜炎（E错）没有或有不明显的胸部刺痛和胸膜摩擦音，胸腔内存在大量液体积聚，听诊可闻及患侧下方呼吸音消失，积液上方肺可闻及代偿性支气管肺泡呼吸音，干性胸膜炎（D错）。肺炎球菌肺炎可咳铁锈色痰，引起胸膜炎（A对）。葡萄球菌肺炎（P48）（B错）起病急骤，寒战、高热，体温多高达39～40℃，胸痛，痰多，呈脓血状，早期可无体征，常与严重的中毒症状与呼吸道症状不平行。癌性胸膜炎（C错）常一起增长迅速的大量血性腹水，此时胸痛不明显，但听诊可闻及患侧下方呼吸音消失，积液上方可闻及代偿性支气管肺泡呼吸音。